重度蛋白质-能量营养不良患儿，夜间睡眠中突然昏迷，死亡。其最主要原因是
A. 窒息
B. 低血容量休克
C. 败血症并急性化脓性脑膜炎
D. 心力衰竭
E. 自发性低血糖发作

正确答案：E。自发性低血糖发作

解析：蛋白质-能量营养不良的并发症有：①小细胞低色素性贫血②多种维生素缺乏③感染④自发性低血糖。由此可知所有选项中只有自发性低血糖发作属于蛋白质-能量营养不良的并发症，窒息（A错）、低血容量休克（B错）、败血症并急性化脓性脑膜炎（C错）、心力衰竭（D错）不属于蛋白质-能量营养不良的并发症。另外患儿的临床表现：突然昏迷、死亡，也再次说明是发生了自发性低血糖发作（E对）。